某职业病防治院测定了11名石棉沉着病患者、9名石棉沉着病可疑患者和11名正常人的用力肺活量，求得其均数分别为1.79L、2.31L和3.08L，能否据此认为石棉沉着病患者、石棉沉着病可疑患者和正常人的用力肺活量不全相同
A. 能，因3个样本均数不同
B. 需作3个均数的两两t检验才能确定
C. 需作3个均数的两两SNK-q检验才能确定
D. 需作完全随机设计3个均数比较的方差分析才能确定
E. 需作配伍组随机设计3个均数比较的方差分析才能确定

正确答案：D。需作完全随机设计3个均数比较的方差分析才能确定